在水中不溶但可膨胀的分离材料是
A. 葡聚糖凝胶
B. 氧化铝
C. 硅胶
D. 透析膜
E. 活性炭

正确答案：A。葡聚糖凝胶

解析：本题考查的是凝胶色谱法。在水中不溶但可膨胀的分离材料是聚糖凝胶（A对）。凝胶色谱法：凝胶色谱法也称凝胶过滤法、凝胶渗透色谱法、分子筛过滤或排阻色谱，是根据物质分子大小差别进行分离。该法所用载体，如葡聚糖凝胶，是在水中不溶、但可膨胀的球形颗粒，具有三维空间的网状结构。氧化铝（B错）为吸附剂，分离原理都是根据吸附能力大小不同进行分离。另外，氧化铝又分为酸性或碱性氧化铝，如黄酮等酚酸性物质被碱性氧化铝的吸附，或生物碱被酸性氧化铝的吸附等，这又属于化学吸附。硅胶（C错）为物理吸附剂，分离原理都是根据吸附能力大小不同进行分离。透析膜（D错）用于透析法。对于生物大分子，一般可以通过透析法对其进行浓缩和精制。透析法是一种根据溶液中分子的大小和形态，在微米（μm）数量级下选择性过滤的技术。在常压下，选择性的使溶剂和小分子物质通过透析膜，大分子不能通过，以达到分离纯化的目的，从本质上讲它是一种溶液相的分子筛作用。活性炭（E错）是非极性吸附剂，与硅胶、氧化铝相反，对非极性物质具有较强的亲和能力，在水中对溶质表现出强的吸附能力。溶剂极性降低，则活性炭对溶质的吸附能力也随之降低。故从活性炭上洗脱被吸附物质时，洗脱溶剂的洗脱能力将随溶剂极性的降低而增强。